下列表述错误的是
A. 母乳中含铁量很低
B. 母乳中的铁吸收利用率差
C. 婴儿体内总铁约75mg/kg
D. 出生4～6个月后体内的铁几乎消耗殆尽
E. 动物食品中铁的吸收率高

正确答案：B。母乳中的铁吸收利用率差